女，23岁。自幼患先天性心脏病，近两个月来发热，体温波动在37.5～38.5°C，全身乏力，无咳嗽，间断抗生素治疗，疗效不佳。查体:胸骨左缘第三肋间可闻及全收缩期杂音。为明确诊断，主要检查是
A. 心电图
B. 胸部X线片
C. 超声心动图
D. 血钾浓度
E. 血沉

正确答案：C。超声心动图

解析：青年女性，先天性心脏病史（为亚急性感染性心内膜炎常见发病因素），近两个月发热、体温波动在37.5～38.5℃（发热是感染性心内膜炎最常见的症状，体温一般＜39℃），全身乏力，查体：胸骨左缘第三肋间可闻及全收缩期杂音（提示主动脉瓣狭窄，可由先心病引起），综合患者的病史、体征及查体，可初步诊断为感染性心内膜炎，为明确诊断，可进行超声心动图（C对）检查，若发现赘生物，则可确诊。心电图（A错）可帮助诊断心律失常，以及心肌缺血、心肌梗死的部位，并不能确诊心内膜炎。胸部X线片（B错）可用于观察肺部的大体病变及心腔增大情况。血钾浓度（D错）主要用于判断高钾血症和低钾血症。血沉（E错）可用于心肌梗死和心绞痛的鉴别诊断。